男，足月产，生后3天出现皮肤轻度黄染，吃奶好，无发热。肝脾不大，脐无分泌物，血清总胆红素175mmol/L（10mg/dl）血型母A子O，应考虑为
A. 新生儿溶血病
B. 新生儿败血症
C. 新生儿肝炎
D. 生理性黄疸
E. 新生儿胆道闭锁

正确答案：D。生理性黄疸

解析：该患儿，出生后3天除黄疸外无其他异常，符合生理性黄疸的诊断（D对）。新生儿溶血病一般发生在母亲0型而胎儿A型或B型的情况，该病例母A子O，不会发生新生儿溶血（A错）。新生儿败血症一般表现为反应差、嗜睡、发热或体温不升、少吃、少哭、少动、体重不增或增长缓慢等症状，而该患儿出有黄疸的临床表现外其它情况都很好，与新生儿败血症的表现不符（B错）。新生儿肝炎：在围生期一般有宫内感染的病史，胎儿出生后有明显肝功能损害的临床表现。因此不能诊断为新生儿肝炎（C错）。该患儿出生3天有黄疸，是生理性黄疸，属于正常情况，并不是由解剖因素所导致的黄疸，不能诊断为胆道闭锁（E错）。